省级价格主管部门负责制定国家基本医疗保障用药中的
A. 化学药品价格
B. 中药价格
C. 中成药价格
D. 处方药价格
E. 非处方药价格

正确答案：E。非处方药价格

解析：本题考查国家基本医疗保障用药价格的制定。省级价格主管部门负责制定国家基本医疗保障用药中的非处方药价格（E对）。国务院价格主管部门负责制定国家基本医疗保障用药中处方药的价格（D错）以及特殊管理药品的价格。